濒临灭绝状态的稀有珍贵野生药材是
A. 羚羊角
B. 黄芩
C. 天麻
D. 丹参
E. 甘草

正确答案：A。羚羊角

解析：本题考查野生药材物种。濒临灭绝状态的稀有珍贵野生药材是羚羊角（A对）。一级保护野生药材物种系指濒临灭绝状态的稀有珍贵野生药材物种。一级保护野生药材物种包括：虎骨、豹骨、羚羊角、鹿茸（梅花鹿）。黄芩（B错）为三级保护野生药材物种。甘草（E错）为二级保护野生药材物种。天麻（C错）和丹参（D错）未列入国家重点保护的野生药材目录。